鼻渊，胆经郁热证可见
A. 鼻涕黄浊
B. 头痛较剧
C. 口苦咽干
D. 耳鸣耳聋
E. 寐少梦多

正确答案：A、B、C、D、E。鼻涕黄浊；头痛较剧；口苦咽干；耳鸣耳聋；寐少梦多

解析：本题考查的是鼻渊的辨证论治。鼻渊，胆经郁热证可见鼻涕黄浊（A对）、头痛较剧（B对）、口苦咽干（C对）、耳鸣耳聋（D对）与寐少梦多（E对）。鼻渊胆经郁热证：【症状】脓涕量多，色黄或黄绿，或有臭味，鼻塞重，嗅觉差，鼻黏膜红赤。伴头痛较剧，口苦，咽干，目眩，耳鸣，耳聋，寐少梦多，烦躁易怒，小便黄赤。舌质红，舌苔黄或腻，脉弦数。